肾上腺素中酮体的检查方法是
A. 比色法
B. 薄层色谱法
C. 比浊法
D. 紫外分光光度法
E. 旋光度法

正确答案：D。紫外分光光度法

解析：本题考查药物中杂质的检查。肾上腺素中酮体的检查方法是紫外分光光度法（D对）。检查原理是利用酮体在310nm波长有最大吸收，而肾上腺素主成分在此波长几乎无吸收，因此通过限制在310nm波长处的吸光度值，即可达到限制相应酮体含量的目的。比色法（A错）的原理是以生成有色化合物的显色反应为基础，利用有色物质溶液的颜色与其浓度的比例关系（朗伯-比尔定律），通过比较或测量有色物质溶液颜色深度来确定待测组分浓度。薄层色谱法（B错）主要用于药物中特定杂质、有关物质与残留溶剂的检查，常用方法有杂质对照法与自身稀释对照法，而布洛芬中“有关物质”检查即采用自身稀释对照法。比浊法（C错）又称浊度测定法。为测量透过悬浮质点介质的光强度来确定悬浮物质浓度的方法。旋光度法（E错）是利用平面偏振光通过含有某些光学活性物质（如具有不对称碳原子的化合物）的液体或溶液时发生的旋光现象来测量药物或检查药物的纯杂程度的方法。该法多用于肾上腺素、硫酸奎宁等药物的鉴别。